某弱酸性药物的pKa是3.4，在血浆中的解离百分率约为
A. 0.01
B. 0.1
C. 0.9
D. 0.99
E. 0.9999

正确答案：E。0.9999